地方性甲状腺肿发病率逐渐下降的年龄为
A. 1～10岁
B. 15～20岁
C. 25～35岁
D. 40岁以后
E. 50岁以后

正确答案：E。50岁以后

解析：本题考查地方性甲状腺肿发病率逐渐下降的年龄。地方性甲状腺肿是一种主要由于地区性环境缺碘引起的地方病，是碘缺乏病的主要表现形式之一。其发病率逐渐下降的年龄为50岁以后（E对ABCD错）。